艾滋病患者在口腔可出现以下表现，但不包括
A. Kaposi肉瘤
B. 念珠菌病
C. 坏死性龈炎
D. 韦格内肉芽肿
E. 非霍奇金淋巴瘤

正确答案：D。韦格内肉芽肿

解析：本题考查HIV感染的口腔表现。艾滋病患者在口腔可出现以下表现，但不包括韦格内肉芽肿（D错，为本题的正确答案）。韦格纳肉芽肿的病因目前尚不明确，但与HIV感染无关。Kaposi肉瘤（A对）即卡波西肉瘤是HIV感染中最常见的口腔恶性肿瘤，是艾滋病的临床诊断指证之一。口腔念珠菌病（B对）在HIV感染者的口腔损害中最为常见，而且常在疾病早期就表现出来，是免疫抑制的早期征象。急性坏死性溃疡性牙龈炎（C对）是HIV的相关性牙周病。非霍奇金淋巴瘤（E对）是HIV感染在口腔的口腔表现，是第二大常见的HIV相关性肿瘤。